急性心肌梗死的超急性期心电图改变是
A. ST段明显抬高
B. 异常宽深的Q波
C. T波高耸
D. T波倒置
E. R波降低

正确答案：C。T波高耸

解析：急性心肌梗死发生后，心电图的变化会随心肌缺血、损伤、坏死的发展和恢复呈现一个动态演变过程。发病数分钟后，首先进入超急性期，由于心内膜下心肌缺血，产生高大的T波（C对），此期一般持续数小时，若得不到及时的干预和治疗，心肌梗死将进一步向急性期发展。急性期ST段明显抬高（A错）、R波降低（E错）、T波倒置（D错）。梗死后数周至数月进入近期，此期以坏死及缺血图形为主要特征。数月之后，进入陈旧期，出现异常宽深的Q波（B错）。